沿颈外静脉排列
A. 颈外侧浅淋巴结
B. 颈外侧上深淋巴结
C. 颈外侧下深淋巴结
D. 咽后淋巴结
E. 颈前浅淋巴结

正确答案：A。颈外侧浅淋巴结

解析：颈外侧浅淋巴结（A对）沿颈外静脉排列。颈外侧上深淋巴结（B错）主要沿颈内静脉上段排列。颈外侧下深淋巴结（C错）主要沿颈内静脉下段排列。咽后淋巴结（D错）位于咽喉壁和椎前筋膜之间。颈前浅淋巴结（E错）沿颈前静脉排列。